下列疾病，不会出现脉搏强而大的是
A. 甲亢
B. 发热
C. 主动脉瓣狭窄
D. 主动脉瓣关闭不全
E. 高血压病

正确答案：C。主动脉瓣狭窄

解析：不会出现脉搏强而大的是主动脉瓣狭窄。由于甲状腺合成释放过多的甲状腺激素，造成机体代谢亢进和交感神经兴奋，故会出现脉搏强而大（A错）。正常人在体温调节中枢的调控下，机体的产热和散热过程经常保持动态平衡，当机体在致热源作用下或体温中枢的功能障碍时，使产热过程增加，而散热不能相应地随之增加或散热减少，故会出现脉搏强而大（B错）。大量的主动脉瓣反流同时造成心脏舒张压下降，心脏在舒张期对冠状动脉的灌注减少，患者可出现心绞痛的症状。左心室的舒张压升高引起左心房的压力增加，导致左心房增大，出现心房纤颤，故会出现脉搏强而大（D错）。高血压病常见的症状是头晕、头痛、颈项板紧、疲劳、心悸等，故会出现脉搏强而大（E错）。